小儿癫痫痰痫证的治法是
A. 祛风涤痰
B. 熄风开窍
C. 健脾化痰
D. 通窍定痫
E. 豁痰开窍

正确答案：E。豁痰开窍

解析：小儿癫痫痰痫证是由于痰浊留滞，蒙蔽心窍而致。痰痫的病因与风邪无关，故（AB错）。健脾化痰为小儿癫痫脾虚痰盛证的治法（C错）。痰痫为痰浊蒙蔽心窍，故应豁痰（D错）。豁痰开窍为痰浊蒙蔽心窍的治法（E对）。